发热激活物的作用部位是
A. 下丘脑体温调节中枢
B. 骨骼肌
C. 产EP细胞
D. 皮肤血管
E. 汗腺

正确答案：C。产EP细胞

解析：发热激活物作用于机体，激活产产EP细胞（C对）使之产生和释放内生致热原，从而引起体温升高，可见产EP细胞是发热激活物作用的部位。下丘脑体温调节中枢（A错）、骨骼肌（B错）、皮肤血管（D错）、汗腺（E错）都不是发热激活物的作用部位。